以下哪种情况应该避免根管再治疗
A. 临产的最后1个月
B. 妊娠的第6个月
C. 根管欠填的患牙
D. 根管治疗后4～5年根尖周病损仍持续
E. 根管治疗4年后需重新进行冠修复的患牙

正确答案：A。临产的最后1个月

解析：妊娠前3个月和临产的最后1个月应避免进行根管再治疗。掌握“根管再治疗”知识点。